乙肝感染者作为传染源的主要血清学依据是
A. HBV DNA
B. 抗-HBc
C. 抗-HBs
D. 抗-HBe
E. HBeAg

正确答案：A。HBV DNA

解析：本题考查乙肝感染者作为传染源的主要血清学依据。乙肝感染者作为传染源的主要血清学依据是HBV DNA（A对BCDE错）。HBV DNA的意义：主要是定性和定量。定性，即确定是阴性还是阳性。定量，即检测乙肝病毒在血液中的含量。